患者，男，50岁，BMI30.0kg/m²，有痛风病史，体检查血压175/90mmHg，不宜选用的降压药物是
A. α受体阻断剂
B. 噻嗪类利尿剂
C. 血管紧张素转换酶抑制剂
D. 钙通道阻滞剂
E. β受体阻断剂

正确答案：B。噻嗪类利尿剂

解析：本题考查药物的不良反应。不宜选用的降压药物是噻嗪类利尿剂（B错，为本题正确答案）。α受体阻断剂（A对）、噻嗪类利尿剂、血管紧张素转换酶抑制剂（C错）、钙通道阻滞剂（D错）、β受体阻断剂（E错）均为降压药物。其中，噻嗪类利尿剂禁用于痛风患者，高尿酸血症以及明显肾功能不全者慎用。